患者，女，43岁，1周前右上第一前磨牙开始咀嚼痛，伴有右侧眶下区肿痛3天。检查见右眶下肿胀明显、右上第一前磨牙深龋，髓腔暴露，叩诊（+++），前庭沟肿胀，压痛，有波动感。根据上述症状，该患者最可能的诊断是
A. 急性根尖周炎
B. 慢性根尖周炎
C. 急性牙髓炎
D. 慢性牙髓炎急性发作
E. 根尖周炎伴眶下间隙感染

正确答案：E。根尖周炎伴眶下间隙感染

解析：本题考查间隙感染概述、眶下间隙、咬肌间隙感染。根据题干的描述，起初是咀嚼痛，后伴有眶下区肿胀、压痛，检查患牙有龋坏，叩诊（+++），可诊断为根尖周炎伴眶下间隙感染（E对）。